患者突然意识丧失，摔倒在地，上睑抬起，眼球上翻，喉部痉挛，发出叫声，兼见心率增快，血压升高，可诊断为癫痫全面发作的
A. 强直期
B. 痉挛期
C. 阵挛期
D. 痉挛后期
E. 阵挛后期

正确答案：A。强直期

解析：全面强直—阵挛发作，通常称为大发作，以意识丧失和全身对称性强直后阵挛为特征。可分为三期：1.强直期 2.阵挛期 震颤幅度增大并延及全身，发作呈对称性、节律性四肢抽动，先快后慢。不同肌群呈强直和松弛交替出现，阵挛频率渐慢，松弛期逐渐延长，本期持续1/2-1分钟；最后一次强烈阵挛后抽搐停止，所有肌肉松弛。在以上两期中可见舌咬伤、心率增快、血压升高、呼吸暂时中断、皮肤紫绀及汗液、唾液和支气管分泌物增多，合并瞳孔扩大，对光反射、深反射和浅反射消失，病理反射阳性等（C错）。3.发作后期 此期仍有短暂强直阵挛，造成牙关紧闭和大小便失禁。呼吸先恢复，口鼻喷出泡沫或血沫，随后心率、血压、瞳孔等恢复正常，肌张力松弛，意识逐渐恢复（D、E错）。